症见壮热，烦渴，面红，目赤，尿黄，便干，苔黄，脉数者。属于
A. 假热证
B. 假寒证
C. 虚热证
D. 实热证
E. 寒热夹杂证

正确答案：D。实热证

解析：患者实热内盛，热邪燔灼故发热壮热；热耗大肠、膀胱津液故尿黄，便干；津液耗伤故烦渴欲饮；邪热上攻头目舌苔故面红，目赤，苔黄；热迫血行故脉数（D对）。假热证为内真寒外假热，虽自觉发热，但触之胸腹无灼热，且欲盖衣被；虽面色红，但为两颧浮红，时隐时现；虽口渴，却欲热饮，且饮水不多；虽咽喉疼痛，但不红肿；虽脉浮大或数，但按之无力（A错）。假寒证为内真热外假寒，出现四肢厥冷、脉沉迟等假寒证，热深厥亦深（B错）。虚热证是正气不足所致的热证，证见心烦不眠，口燥咽干，潮热盗汗，大便秘结，舌红，脉细数（C错）。寒热夹杂证是指在同一病人身上同时出现寒证和热证，呈现寒热交错的现象（E错）。